在人类生态学上，疾病发生的三大要素是
A. 患者、潜在性患者、健康者
B. 感受性、传播途径、传染源
C. 宿主、环境、致病因子
D. 理化因素、生物学因素、社会经济因索
E. 遗传、营养、身体锻炼

正确答案：C。宿主、环境、致病因子